关于登革病毒叙述错误的是
A. 属于无包膜RNA病毒
B. 以蚊为传播媒介
C. 引起登革热
D. 临床表现形式有登革热、登革出血热、登革热-休克综合征3种
E. 机体感染后以体液免疫为主

正确答案：A。属于无包膜RNA病毒